男，62岁。间隔咳嗽、咳痰10余年，喘息5年，加重3天入院。吸烟41年，30支/日，已戒5年。查体：烦躁，球结膜充血、水肿，口唇发绀。桶状胸，双肺呼吸音低，右下肺可闻及少许湿性啰音，肝肋下5cm，肝颈静脉回流征（+），双下肢水肿。血K⁺4.5mmol/L。Na⁺129mmol/L，Cl⁻90mmol/L。该患者目前最重要的治疗措施为
A. 抗感染
B. 静脉滴注支链氨基酸
C. 无创通气
D. 利尿
E. 纠正电解质紊乱

正确答案：A。抗感染

解析：患者为中老年男性，既往有吸烟病史（慢阻肺最重要的环境致病因素），间隔咳嗽、咳痰，喘息，桶状胸（为慢阻肺的典型表现），双肺呼吸音低，提示为慢阻肺（COPD）。烦躁，球结膜充血、水肿，口唇发绀，肝肋下5cm，肝颈静脉回流征（+），双下肢水肿（为右心衰竭的表现），根据其临床表现和体征，考虑诊断为慢性肺源性心脏病肺、心功能失代偿期（肝大、肝颈静脉回流征（+）、下肢水肿提示已经进入肺、心功能失代偿期）。失代偿期的治疗原则为积极控制感染，通畅呼吸道，改善呼吸功能，其中感染是引起慢性肺心病急性加重致肺、心功能失代偿的常见原因，故需积极控制感染（A对）。静脉滴注支链氨基酸（B错）主要用于肝性脑病的治疗。无创通气（C错）、纠正电解质紊乱（E错）为对症治疗，不是最重要的治疗措施。利尿（D错）的应用需谨慎，用药后易出现低钾、低氯性碱中毒，痰液粘稠不易排痰和血液浓缩，也不是最主要的治疗措施。